关于肝硬化的叙述中正确的是
A. 亚急性重症型病毒性肝炎多发展为门脉性肝硬化
B. 病变特点是肝细胞坏死纤维组织增生和假小叶形成
C. 门脉高压症可表现为出血倾向
D. 肝功能不全可表现为脾肿大
E. 肝硬化不发生癌变

正确答案：B。病变特点是肝细胞坏死纤维组织增生和假小叶形成

解析：肝硬化是以肝细胞坏死、纤维组织增生和假小叶形成为病变特点的慢性肝脏疾病（B对）。亚急性重型肝炎多数继续发展而转变为坏死后性肝硬化（A错）。门脉性肝硬化的主要临床病变为门脉高压症和肝功能不全（障碍），其中门脉高压症可表现为慢性淤血性脾大（C错）；肝功能不全可表现为出血倾向（D错）。肝硬化可发生癌变（E错）。